下列参与体液调节过程的化学物质来源，正确的是
A. 胰岛素
B. 肾上腺素
C. 5-羟色胺
D. 腺苷
E. 以上均正确

正确答案：E。以上均正确